问病员“你想什么”，病员答“详细地讲就是细菌问题，细菌在我们脑子里有些冲动力，空气不大新鲜，也不奇怪，冻死苍蝇”。该患者的精神症状属于
A. 思维破裂
B. 思维散漫
C. 音联意联
D. 强制性思维
E. 思维奔逸

正确答案：A。思维破裂

解析：思维破裂指概念之间的联想断裂，各句含意互不相关，变成语词堆积（A对）。思维散漫表现为在交谈时，内容散漫，缺乏主题，话题转换缺乏必要的联系（B错）。音联意联是指音韵联想和字意联想（C错）。强制性思维是指患者体验到强制性地涌现大量无实际意义的联想（D错）。思维奔逸表现为特别健谈，说话滔滔不绝，口若悬河，感到脑子特别灵活，就像机器加了“润滑油”一样难以停顿下来（E错）。